心身疾风怒涛的时期
A. 幼儿
B. 儿童
C. 中年
D. 老年
E. 青少年

正确答案：E。青少年

解析：青少年心身发展快，达到了一生中的最高峰。但由于变化快，稳定性差，又像一个疾风怒涛的时期。掌握“不同年龄阶段心理卫生”知识点。